药材呈扁圆柱形，表面金黄色或黄中带绿色，质硬而脆，味苦的是
A. 环草石斛
B. 耳环石斛
C. 黄草石斛
D. 马鞭石斛
E. 金钗石斛

正确答案：E。金钗石斛